选择上颌无牙颌托盘时，其后缘长度应
A. 在翼上颌切迹与腭小凹的连线上
B. 超过颤动线0.5mm
C. 超过颤动线lmm
D. 与颤动线平齐
E. 超过颤动线3～4mm

正确答案：E。超过颤动线3～4mm

解析：本题考查无牙颌托盘的选择。上颌总义齿后缘的正确位置应在翼上颌切迹与腭小凹后2mm的连线上，即后颤动线处。因此，上颌无牙颌成品托盘的后缘应超过腭小凹和颤动线位置，超过颤动线3～4mm（E对），以保证获得准确的后颤动线的位置形态，从而获得精确的模型，能够确定义齿基托后缘和制作后堤区。在翼上颌切迹与腭小凹的连线上（A错）、超过颤动线0.5mm（B错）、超过颤动线lmm（C错）、与颤动线平齐（D错）都无法准确取得翼上颌切迹与腭小凹后2mm的形态，则制作义齿时无法保证边缘封闭，得不到良好固位。